似橘瓣状，表面灰黑色或淡黄白色，背面有一条浅纵沟，腹面棱线下端有一点状种脐的饮片是
A. 沙苑子
B. 牵牛子
C. 补骨脂
D. 女贞子
E. 菟丝子

正确答案：B。牵牛子

解析：本题考查的是牵牛子药材的性状鉴别。似橘瓣状，表面灰黑色或淡黄白色，背面有一条浅纵沟，腹面棱线下端有一点状种脐的饮片是牵牛子（B对）。牵牛子：【性状鉴别】药材似橘瓣状。表面灰黑色或淡黄白色，背面有1条浅纵沟，腹面棱线的下端有一点状种脐，微凹。质硬，横切面可见淡黄色或黄绿色皱缩折叠的子叶，微显油性。气微，味辛、苦，有麻感。加水浸泡后种皮呈龟裂状，手捻有明显的黏滑感。沙苑子（A错）：【性状鉴别】药材略呈圆肾形而稍扁。表面绿褐色至灰褐色，光滑，边缘一侧微凹处具圆形种脐。质坚硬，不易破碎。除去种皮，有淡黄色子叶2片，胚根弯曲。气微，味淡，嚼之有豆腥味。补骨脂（C错）：【性状鉴别】药材呈肾形，略扁。表面黑色、黑褐色或灰褐色，具细微网状皱纹。顶端圆钝，有一小突起，凹侧有果梗痕。质硬。果皮薄，与种子不易分离；种子1枚，子叶2，黄白色，有油性。气香，味辛、微苦。女贞子（D错）：【性状鉴别】药材呈卵形、椭圆形或肾形。表面黑紫色或灰黑色，皱缩不平。基部有果梗痕或具宿萼及短梗。体轻。外果皮薄，中果皮较松软，易剥离，内果皮木质，黄棕色，具纵棱，破开后种子通常为1粒，肾形，紫黑色，油性。气微，味甘、微苦涩。菟丝子（E错）：【性状鉴别】药材呈类球形。表面灰棕色或黄棕色，粗糙，种脐线形或扁圆形。质坚实，不易以指甲压碎。气微，味淡。